致矽肺的物质是
A. 石棉
B. 玻璃棉
C. 二氧化硅
D. 木粉
E. 水泥尘

正确答案：C。二氧化硅

解析：本题考查矽肺的诱因。矽肺是由于在生产过程中长期吸入游离二氧化硅（C对ABDE错）粉尘而引起的以肺部弥漫性纤维化为主的全身性疾病。矽肺发病与下列因素有关：粉尘中游离SiO₂含量、SiO₂类型、粉尘浓度、分散度、接尘工龄、防护措施、接触者个体因素等。